清心利水养阴的方剂是
A. 导赤散
B. 清胃散
C. 龙胆泻肝汤
D. 泻白散
E. 清暑益气汤

正确答案：A。导赤散

解析：清心利水养阴的方剂是导赤散。主治心经火热证，本方由心经热盛或移于小肠所致，为治疗心经火热证的常用方，又是体现清热利水养阴治法的基础方（A对）。清胃散功用清胃凉血（B错）。龙胆泻肝汤功用清泻肝胆实火，清利肝经湿热（C错）。泻白散功用清泻肺热，止咳平喘（D错）。清暑益气汤功用清暑益气，养阴生津（E错）。